右心衰竭的主要表现是
A. 肺水肿
B. 肝肿大压痛
C. 两者均有
D. 两者均无
E. 无

正确答案：B。肝肿大压痛

解析：右心衰竭时，右心室泵血功能减退，导致右心输出量不足，进而使心室收缩后滞留于内的血液增多，心室舒张期充盈压升高，体循环血液回流受阻，造成体循环淤血，肝脏淤血时可表现为肝肿大压痛（B对）。同理，左心衰竭可导致肺循环淤血，严重时血浆可渗出至肺实质、间质，造成肺水肿（A错）。